360度评估是指由员工本人、领导、下属、同事和顾客等从全方位、各个角度来评估员工的方法。按照心理评估的分类，这种方法属于
A. 调查法
B. 会谈法
C. 心理测验法
D. 观察法
E. 临床评定量表

正确答案：A。调查法

解析：心理评估的方法：观察法、会谈法、调查法、心理测验及临床评定量表。观察法（D错）是通过对被评估者的行为表现直接或间接（通过摄录像设备等）的观察或观测而进行心理评估的一种方法。会谈法（B错）是评估者与被评估者面对面的语言交流。调查法（A对）通过向周围人进行询间等形式获得当事人的情况。心理测验及临床评定量表（CE错）依据一定法则，用数量化手段对心理现象或行为加以确定和测定。因此由员工本人、领导、下属、同事和顾客等从全方位、各个角度来评估员工的方法属于调查法（A对）。